巴比妥类药物解离度与药物的pKₐ和环境pH有关。在生理pH=7.4时，分子态形式和离子态形式比例接近的巴比妥类药物是
A. 异戊巴比妥（pKₐ7.9）
B. 司可巴比妥（pKₐ7.9）
C. 戊巴比妥（pKₐ8.0）
D. 海索比妥（pKₐ8.4）
E. 苯巴比妥（pKₐ7.3）

正确答案：E。苯巴比妥（pKₐ7.3）

解析：本题考查药物的解离度对药效的影响。苯巴比妥（E对）是将巴比妥酸的5位双取代，pKₐ值达到7.0～8.5之间，在生理pH（pH=7.34～7.45）下，pKₐ=pH，非解离型与解离型药物各占一半，即约有50%左右以分子形式存在，其分子态形式和离子态形式比例接近。而异戊巴比妥（pKₐ7.9）（A错）、司可巴比妥（pKₐ7.9）（B错）、戊巴比妥（pKₐ8.0）（C错）与海索比妥（pKₐ8.4）（D错）在生理pH下，pKₐ＞pH，则分子型药物所占比例高于离子型药物。